出现糖尿病酮尿可提示
A. 活动性肢端肥大症
B. 甲状腺功能亢进
C. 胰岛素分泌过度
D. 麻疹、伤寒、猩红热
E. 糖尿病尚未控制

正确答案：E。糖尿病尚未控制

解析：本题考查尿常规检查。出现糖尿病酮尿可提示糖尿病尚未控制（E对）。 糖尿病酮尿：糖尿病尚未控制或未曾治疗，持续出现酮尿提示有酮症酸中毒，尿液中排出大量酮体，常早于血液中酮体的升高。严重糖尿病酮症时，尿液中酮体可达6g/24h。